以下关于半固定桥的说法中错误的是
A. 倾斜基牙为获得共同就位道
B. 保护缺隙一侧支持力较弱的基牙
C. 含中间基牙的多单位固定桥，保护中间基牙
D. 可动连接体的栓道位于固位体上
E. 可动连接体一般用栓道式附着体

正确答案：C。含中间基牙的多单位固定桥，保护中间基牙

解析：本题考查半固定桥。关于半固定桥的说法中错误的是含中间基牙的多单位固定桥，保护中间基牙（C错，为本题的正确答案）。设计半固定桥的主要目的是为求得倾斜基牙的共同就位道，在实际情况中，半固定桥对基牙的保护作用较差，可用于牙间隔缺失作复合桥时中间基牙的远中部分，单纯的半固定桥不含中间基牙，且对基牙的保护作用不大，不能保护中间基牙。半固定桥适用于倾斜基牙为获得共同就位道（A对）的病例。半固定桥其一端桥体与固位体之间为固定连接，另一端为可动连接，可动连接体一般用栓道式附着体（E对），以便倾斜基牙易于取得共同就位道，从而避免在基牙预备过程中因牙体组织切割过多而露髓。栓道式附着体通常由栓体和栓道组合而成，可动连接体的栓道位于固位体上（D对），栓体位于桥体上，通过栓体嵌合于栓道内形成可动连接体。因半固定桥两端桥体与固位体的连接方式不同，两端基牙所承受的应力也不均匀，当桥体正中受到垂直向牙合力时，固定连接端的基牙所受的力大于可动连接端基牙：在可动侧，力通过可动连接体的传导，使应力得以分散和缓冲，而固定侧基牙则需承担较大的力。可以通过将可动连接体置于缺隙一侧支持力较弱的基牙旁来使该基牙所受的应力得到一定的分散和缓冲，从而起到保护缺隙一侧支持力较弱的基牙（B对）的目的。但实际上，这种保护作用是相对的，不论是可动连接侧基牙还是固定连接侧基牙，固定桥对其保护作用都比较弱，只是相较于固定连接侧基牙，可动连接侧基牙受的力更小，处于一种相对受保护的状态。